肩关节脱位
A. “餐叉”样畸形
B. 下肢短缩、外旋畸形
C. 腕下垂
D. 下肢短缩、内旋、内收畸形
E. Dugas征阳性

正确答案：E。Dugas征阳性

解析：肩关节脱位主要表现为方肩畸形、肩胛盂处空虚感、上肢弹性固定、Dugas征阳性（E对）。“餐叉”样畸形（A错）为伸直型桡骨远端骨折（Colles骨折）的典型表现。下肢短缩外旋畸形（B错）主要见于股骨颈骨折（P659）。腕下垂（C错）为桡神经损伤表现。下肢短缩内旋内收畸形（D错）主要见于髋关节后脱位（P655）。